营养性缺铁性贫血的血象特点是
A. RBC减少比Hb减少明显
B. 粒细胞分叶多
C. MCH=32Pg
D. 红细胞中央淡染区大
E. 粒细胞左移

正确答案：D。红细胞中央淡染区大

解析：铁是血红蛋白合成的原料，营养性缺铁性贫血时，红细胞内缺铁导致血红素合成障碍，血红蛋白合成减少，血片中可见红细胞胞质少、体积小，中央淡染区扩大（D对），平均红细胞体积（MCV）低于80fl，平均红细胞血红蛋白量（MCH）小于27pg（C错），平均红细胞血红蛋白浓度（MCHC）小于32%，呈小细胞低色素性贫血，当缺铁达到一定程度时，红细胞数量也减少（A错）。缺铁性贫血骨髓增生活跃或明显活跃，以红系增生为主，粒系、巨核系无明显异常，故血象中粒细胞形态基本正常。粒细胞分叶多（B错）即核右移主要见于巨幼细胞性贫血和应用抗代谢药物治疗后；粒细胞左移（E错）常见于感染、急性中毒、急性溶血等疾病。